根据《药品广告审查发布标准》，必须在广告中注明“本广告仅供医学药学专业人士阅读”的药品是
A. 氯雷他定（OTC）
B. 艾司唑仑片
C. 阿奇霉素分散片
D. 曲马多
E. 复方樟脑酊

正确答案：C。阿奇霉素分散片

解析：本题考查药品广告管理。